二氢吡啶环上，3，5位取代基均为甲酸甲酯的药物是
A. 氨氯地平
B. 尼卡地平
C. 硝苯地平
D. 尼群地平
E. 尼莫地平

正确答案：C。硝苯地平

解析：本题考查硝苯地平的结构。硝苯地平（C对）为对称结构的二氢吡啶类药物，3，5位都是甲酸甲酯。氨氯地平（A错）不含甲酸甲酯，3位是乙酸乙酯，5位是乙酸甲酯。尼卡地平（B错）只有5位是甲酸甲酯。尼群地平（D错）不含甲酸甲酯，3位和5位的两个羧酸酯的结构相差一个甲基。尼莫地平（E错）不含甲酸甲酯，3位是甲氧乙基酯，5位是异丙酯。